蛛网膜下腔出血的体征是
A. 高热
B. 抽搐
C. “三偏”征
D. 脑膜刺激征明显
E. 脑脊液大多正常

正确答案：D。脑膜刺激征明显

解析：蛛网膜下腔出血的体征是脑膜刺激征明显（D对），脑脊液多为血性（E错），而常无高热（A错）、抽搐（B错）的表现。“三偏”征为丘脑出血的体征（C错）。